具有多环性同心环状排列维管束的药材有
A. 何首乌
B. 牛膝
C. 川牛膝
D. 大黄
E. 商陆

正确答案：B、C、E。牛膝；川牛膝；商陆

解析：本题考查的是多环性同心环维管束的药材。具有多环性同心环状排列维管束的药材有牛膝（B对）、川牛膝（C对）、商陆（E对）。多环性同心环维管束，如牛膝、川牛膝、商陆等。其根在正常次生生长发育到一定阶段时，次生维管柱的外围又形成多轮同心环状排列的异常维管组织，即最初由中柱外方部位韧皮薄壁细胞分裂产生薄壁组织，从中发生新的形成层环，并形成第一轮同心环维管束，以后随着外方薄壁细胞继续分裂，又相继形成第二轮、第三轮等同心环维管束，如此构成多环性同心环维管束的异常构造。何首乌（A错）【性状鉴别】药材呈团块状或不规则纺锤形。表面红棕色或红褐色，皱缩不平，有浅沟，并有横长皮孔样突起及细根痕。体重，质坚实，不易折断，切断面浅黄棕色或浅红棕色，显粉性，类圆形异型维管束环列，形成云锦状花纹，中央木部较大，有的呈木心。大黄（D错）【性状鉴别】药材呈类圆柱形、圆锥形、卵圆形或不规则块片状，长3～17cm，直径3～10cm。除尽外皮者表面黄棕色至红棕色，有的可见类白色网状纹理及“星点”散在，残留的外皮棕褐色，多具绳孔及粗皱纹。质坚实，有的中心稍松软，断面淡红棕色或黄棕色，显颗粒性；根茎髓部宽广，有“星点”环列或散在；根木部发达，具放射状纹理，形成层环明显，无“星点”。